病理过程属于液化性坏死的是
A. 肝脓肿
B. 淋巴结结核
C. 恶性高血压细小动脉
D. 产后子宫内膜炎
E. 以上均不是

正确答案：A。肝脓肿

解析：液化性坏死是指因坏死组织中可凝固的蛋白质少，或坏死细胞自身及浸润的中性粒细胞等释放大量水解酶，或组织富含水分和磷脂，导致细胞组织坏死后易发生溶解液化。属于液化性坏死的有细菌或真菌引起的脓肿，如肝脓肿（A对）及脑软化等。淋巴结结核（P358）（B错）的病理过程主要是干酪样坏死（P21），即坏死更为彻底的凝固性坏死。恶性高血压细小动脉（P142）（C错）的病理过程主要是纤维素样坏死。产后子宫内膜炎（D错）即急性子宫内膜炎，是发生在产后，表现为明显全身症状的炎症反应，其病理过程主要是渗出性病变。